文化影响健康的特征是
A. 无形性、本源性、社会性、软约束
B. 无形性、本源性、稳定性、软约束
C. 无形性、本源性、稳定性、社会性
D. 无形性、本源性、稳定性、继承性

正确答案：B。无形性、本源性、稳定性、软约束

解析：本题考查文化影响健康的特征。文化影响健康的特征是：无形性、本源性、软约束性、稳定性（B对ACD错）、民族性。